既至目外眦，又至目内眦的经脉是
A. 手少阳三焦经
B. 足少阳胆经
C. 手太阳小肠经
D. 手阳明大肠经
E. 足太阳膀胱经

正确答案：C。手太阳小肠经

解析：该题主要考查十二经脉的循行部位。手太阳小肠经从缺盆分出一支，沿颈部上行到面颊，至目外眦；手太阳小肠经还从面颊部分出一支，向上行于目眶下，至目内眦（睛明穴）（C对）。手少阳三焦经起于无名指尺侧端（关冲穴），向上沿无名指尺侧至手腕背面，上行前臂外侧尺、桡骨之间，过肘尖，沿上臂外侧向上至肩部，向前行入缺盆，布于膻中，散络心包，穿过膈肌，依次属上、中、下三焦（A错）。足少阳胆经起于目外眦（B错），上至额角（颔厌穴），再向下到耳后（完骨穴），再折向上行，经额部至眉上（阳白穴），又向后折行至风池穴，沿颈下行至肩上，左右交会于大椎穴，分开前行入缺盆。手阳明大肠经起于食指桡侧端（商阳穴），经过手背部行于上肢伸侧外侧前缘，至肩关节前缘，向后到大椎穴，再向前下行入缺盆（从缺盆还分出一支，经颈部至面颊，入下齿中，回出挟口两旁，左右交叉于人中，至对侧迎香穴，交于足阳明胃经），进入胸腔络肺，向下通过膈肌下行至大肠，属大肠（D错）。足太阳膀胱经为起于目内眦（睛明穴）（E错），向上到达额部，左右交会于头顶部（百会穴）。